霍乱弧菌分群的依据是
A. 鞭毛H抗原
B. 菌体O抗原
C. 荚膜抗原
D. 内毒素
E. 肠毒素

正确答案：B。菌体O抗原

解析：WHO腹泻控制中心根据霍乱弧菌O抗原特异性、生化性状及致病性等差异，将霍乱弧菌分为以下三群：O1群霍乱弧菌、非O1群霍乱弧菌、不典型O1群霍乱弧菌（B对）。